输卵管管径最膨大处为
A. 输卵管壶腹
B. 输卵管漏斗
C. 输卵管峡
D. 输卵管伞
E. 子宫部

正确答案：B。输卵管漏斗

解析：输卵管漏斗（B对）是输卵管管径最膨大处。